属于免疫调节治疗肿瘤的方法是
A. 注射TNF-α
B. 注射LAK
C. 注射CTL
D. 注射肿瘤相关Ag疫苗
E. 注射McAb-125I

正确答案：A。注射TNF-α